用于完整皮肤表面，能将药物输送透过皮肤进入血液循环系统起全身作用的是
A. 洗剂
B. 糊剂
C. 酊剂
D. 搽剂
E. 贴剂

正确答案：E。贴剂

解析：本题考查透皮贴剂。用于完整皮肤表面，能将药物输送透过皮肤进入血液循环系统起全身作用的贴剂称为透皮贴剂（E对）。